患者女，56岁，10天来咳嗽发烧38℃，自服感冒药不见好转，黄痰逐渐增多，30～50毫升/天，偶尔有脓血痰。白细胞19×10⁹/L。胸片见右肺有大片模糊阴影，其中有一带液平面的薄壁空洞。门诊首先考虑
A. 肺结核
B. 中央型肺癌
C. 支气管肺炎
D. 肺脓肿
E. 周围型肺癌

正确答案：D。肺脓肿

解析：患者表现为发烧、咳嗽，咳黄痰，白细胞19×10⁹/L（正常值为4～10×10⁹/L），明显升高，提示存在感染，胸片示肺有大片模糊阴影，其中有一带液平面的薄壁空洞（为肺脓肿的典型胸片改变），该患者临床表现及辅助检查符合肺脓肿（D对）的表现。肺结核（P65）（A错）起病缓慢，病程长，有长期低热盗汗的结核毒血症状，X线胸片显示空洞壁较厚，一般无气液平面。中央型肺癌（P77）（B错）表现为刺激性呛咳，很少有黄浓痰，X线胸片显示空洞壁较厚，多呈偏心空洞，内壁凹凸不平。支气管肺炎（C错）表现为发热、咳嗽，气促，X线胸片早期见肺纹理增粗，以后出现小斑片状阴影，以双肺下野、中内带及心膈区居多，并可伴有肺不张或肺气肿，斑片状阴影亦可融合成大片，甚至波及整个节段。周围型肺癌（P77）（E错）表现为咳嗽，痰血，发热，体重下降等原发肿瘤引起的症状，X线胸片显示阴影周围常呈分叶状，伴有脐凹或细毛刺。